慢性支气管炎患者发生阻塞性通气功能障碍的病变基础是
A. 黏膜上皮细胞变性、坏死、脱落
B. 管壁充血水肿
C. 黏膜上皮纤毛倒伏脱失
D. 细支气管周围炎
E. 粘液腺肥大增生，分泌亢进，浆液腺粘液化

正确答案：D。细支气管周围炎

解析：慢性支气管炎的病程漫长，病情反复发作，病变常从较大的支气管开始，逐渐累及较小的支气管和细支气管。随着病情不断加重，累及的细支气管不断增多，同时，炎症向管壁周围组织及肺泡扩展，形成细支气管周围炎（D对），将引起管壁纤维性增厚，管腔狭窄甚至闭锁；最终导致阻塞性通气功能障碍的发生。黏膜上皮细胞变性坏死脱落（A错）、管壁充血水肿（B错）、黏膜上皮纤毛倒伏脱失（C错）以及粘液腺肥大增生，分泌亢进，浆液腺粘液化（E错）均为慢性支气管炎的基本病变，不一定会引发阻塞性通气功能障碍。